推荐剂量下服药期间大便变黑的是
A. 阿司匹林
B. 法莫替丁
C. 葡萄糖酸钙
D. 碱式硝酸铋复方制剂
E. 盐酸异丙嗪（非那根）

正确答案：D。碱式硝酸铋复方制剂

解析：本题考查碱式硝酸铋复方制剂的不良反应。推荐剂量下服药期间大便变黑的是碱式硝酸铋复方制剂（D对）。由于铋制剂的不溶性和局部作用特点，服药期间口中可能带有氨味，并可使舌、大便变黑，牙齿短暂变色，停药后自行消失。阿司匹林（A错）为水杨酸类非甾体抗炎药（NSAID），不良反应最常见为胃肠道反应。法莫替丁（B错）为组胺H₂受体阻滞药，常见的不良反应为头晕、嗜睡，少见定向力障碍、意识混乱、男性乳房肿胀、精神异常等。葡萄糖酸钙（C错）口服一般无不良反应，静脉给药时可能出现全身发热感，静脉速度过快时，可产生心律失常，恶心和呕吐。异丙嗪（E错）为抗精神病药，主要不良反应为锥体外系症状、眩晕、乏力、心动过速或过缓、晕厥、血压升高或降低等。